具有同质多晶性的栓剂油脂性基质是
A. 单硬脂酸酯
B. 甘油明胶
C. 聚乙二醇
D. 可可豆脂
E. 泊洛沙姆

正确答案：D。可可豆脂

解析：本题考查的是栓剂的基质。具有同质多晶性的栓剂油脂性基质是可可豆脂（D对）。油脂性基质，可可豆脂常温下为黄白色固体，可塑性好，无刺激性，能与多种药物配伍使用。可可豆脂具有同质多晶性，有α、β、γ三种晶型。水溶性基质（1）甘油明胶（B错）系用明胶、甘油与水制成，一般明胶与甘油等量，水应控制在10%以下。（2）聚乙二醇（C错）类聚乙二醇1000、聚乙二醇4000、聚乙二醇6000，以两种或两种以上的聚乙二醇加热熔融可制得理想硬度和释药速度的栓剂基质，如聚乙二醇1000：聚乙二醇4000为96：4时释药较快，若比例改为75：25时则释药缓慢。该类基质尚有聚氧乙烯（40）单硬脂酸酯（A错）、聚山梨酯61、泊洛沙姆（E错）等。